用气相色谱法测定维生素E的含量，中国药典（2000年版）规定采用的检测器为
A. 紫外检测器
B. 荧光检测器
C. 热导检测器
D. 氢火焰离子化检测器
E. 质谱检测器

正确答案：D。氢火焰离子化检测器